治疗肺热咳嗽，须发早白，应首选的药物是
A. 白芨
B. 艾叶
C. 小蓟
D. 白茅根
E. 侧柏叶

正确答案：E。侧柏叶

解析：侧柏叶应用于血热出血证，肺热咳嗽,尚有生发乌发之效（E对）。白芨应用于出血证，痈肿疮疡，手足皲裂，水火烫伤而不具有治疗肺热咳嗽，须发早白的功效（A错）。艾叶应用于出血证，月经不调，痛经，胎动不安而不具有治疗肺热咳嗽，须发早白的功效（B错）。小蓟应用于血热出血证，热毒痈肿而不具有治疗肺热咳嗽，须发早白的功效（C错）。白茅根应用于血热出血证，水肿，热淋，黄疸，胃热呕吐，肺热咳喘而不具有治疗肺热咳嗽，须发早白的功效（D错）综上可知治疗肺热咳嗽，须发早白，应首选的药物是侧柏叶。